“实”的病机最根本的方面是
A. 邪气亢盛
B. 气血瘀滞
C. 正气旺盛
D. 水液蓄积
E. 痰浊壅滞

正确答案：A。邪气亢盛

解析：实是以邪气亢盛为矛盾主要方面的病机变化，邪气盛则实（A对）。实证常见于外感六淫和病气所致的外感病证的初期和中期，或由于水湿痰饮、食积、气滞、淤血等引起的内伤病证，实证较多见于体质比较壮实的患者（BDE错）。正气旺盛并非病理表现（C错）。